子宫内膜异位症的确诊依据是
A. 典型的病史
B. B型超声检查
C. 血CA125升高
D. 病理组织学检查
E. 妇科检查

正确答案：D。病理组织学检查

解析：子宫内膜异位症的确诊依据是：在腹腔镜下取典型病灶或可疑病变，进行病理组织学检查（D对）。典型的病史（A错）、B型超声检查（B错）、血CA125升高（C错）及妇科检查（E错）均有助于内异症的诊断，但不可作为确诊依据。